关于腺样囊性癌的叙述，哪项是错误的
A. 最常见于下颌下腺，其次为腭部小涎腺
B. 颈淋巴结转移率低
C. 浸润性极强，易沿神经扩散
D. 易血行转移至肺
E. 不能依据有无骨质破坏来判断颌骨是否被肿瘤侵犯

正确答案：A。最常见于下颌下腺，其次为腭部小涎腺

解析：腺样囊性癌最常见于腭部小唾液腺及腮腺，其次为下颌下腺，发生于舌下腺的肿瘤，多为腺样囊性癌。掌握“腺样囊性癌”知识点。